下列因素中，不是造成疾病季节性流行的因素是
A. 接触机会增加
B. 病原体繁殖高峰
C. 传播途径易于实现
D. 宿主动物繁殖高峰
E. 虫媒繁殖高峰

正确答案：C。传播途径易于实现

解析：本题考查疾病的季节性流行。疾病季节性升高的原因较为复杂，不仅受自然环境、气候条件、媒介昆虫、野生动物的生活习性和家畜的生长繁殖（BDE对）等因素的影响，也受人的生活方式、生产、劳动条件、营养、风俗习惯、医疗卫生水平、暴露于致病因素的机会（A对）和人群易感性的影响。传播途径易于实现（C错，为本题正确答案）是经空气传播的传染病流性特征。